传染病的流行过程是指
A. 传染源不断向外界排出病原体的过程
B. 病原体沿—定传播途径扩散的过程
C. 易感人群受到病原体侵袭而发病的过程
D. 一系列相互联系、相继发生的新旧疫源地的过程
E. 病原体在外界环境中不断繁殖的过程

正确答案：D。一系列相互联系、相继发生的新旧疫源地的过程

解析：本题考查传染病的流行过程。传染病的流行过程是指一系列相互联系、相继发生的新旧疫源地的过程（D对ABCE错）。